指骨属于
A. 长骨
B. 短骨
C. 扁骨
D. 不规则骨
E. 含气骨

正确答案：A。长骨

解析：指骨属长骨，共 14 块（A对）。